下列方法中，不属于包合物验证方法的是
A. 相溶解度法
B. X射线衍射法
C. 热分析法
D. 气体吸附法
E. 红外光谱法

正确答案：D。气体吸附法

解析：本题考查包合物的验证方法。气体吸附法（D错，为本题正确答案）不属于包合物验证法。包合物的验证方法包括相溶解度法、X射线衍射法、热分析法、红外光谱法。